环境毒理学的特殊毒性方法是
A. 急性、亚急性、慢性毒性试验
B. 急性、亚慢性、慢性毒性试验
C. 致癌、致突变、致畸测试方法
D. 致癌、致突变、慢性毒性试验
E. 致突变、致畸、慢性毒性测试方法

正确答案：C。致癌、致突变、致畸测试方法

解析：本题考查环境毒理学的特殊毒性方法。环境毒理学的特殊毒性方法是致癌、致突变、致畸测试方法（C对ABDE错）。